患者，男，50岁。呕吐鲜血约400mL，同时伴有蜘蛛痣、肝掌、脾大、腹壁静脉曲张。应首先考虑的诊断是
A. 食管胃底静脉曲张破裂出血
B. 肝内胆道出血
C. 胃、十二指肠溃疡出血
D. 胃癌
E. 糜烂性胃炎

正确答案：A。食管胃底静脉曲张破裂出血

解析：患者有蜘蛛痣、肝掌、脾大、腹壁静脉曲张的体征，提示处于肝硬化失代偿期，门静脉高压使门-腔侧支循环开放，最常见的并发症是食管胃底静脉曲张破裂导致呕血，故首先诊断为食管胃底静脉曲张破裂出血（A对）。胆道出血（B错）常有肝、胆手术，肝穿刺，肝外伤病史，或者有胆石病、胆道蛔虫、肝胆或胰腺肿瘤病史，表现为上腹或右上腹绞痛或胀痛，并向右肩背部放射，本例患者无明显的胆道疾患，故排除。胃、十二指肠溃疡出血（C错）通常有慢性溃疡病史，而且出血量少，很少出现呕血。胃癌（D错）多数病人早期无明显症状，随着病情发展，病人出现上腹疼痛加重，食欲下降、乏力、消瘦，体重减轻，淋巴结肿大，肿瘤破溃或侵犯胃周围血管后可有呕血、黑便等消化道症状。糜烂性胃炎（E错）又称急性胃炎，常有上腹痛、胀满、恶心、呕吐和食欲不振等。